山楂的功效特点是
A. 消食兼能散瘀
B. 消食兼能发表
C. 消食兼能疏肝
D. 消食兼能化石
E. 消食兼能化痰

正确答案：A。消食兼能散瘀

解析：山楂酸甘，微温不热，具有消食化积的功效，能治各种饮食积滞；本品性温兼入肝经血分，能通气血，有活血祛瘀的功效（A对）。